中毒型菌痢基本病变主要表现是
A. 高热
B. 惊厥
C. 呼吸衰竭
D. 循环衰竭
E. 昏迷

正确答案：C。呼吸衰竭